下列中药中叶片上表面暗灰绿，基部渐狭下延至叶柄，成翼状的药材是
A. 罗布麻叶
B. 艾叶
C. 蓼大青叶
D. 枇杷叶
E. 大青叶

正确答案：E。大青叶

解析：本题考查的是大青叶药材的性状鉴别。下列中药中叶片上表面暗灰绿，基部渐狭下延至叶柄，成翼状的药材是大青叶（E对）。大青叶：【性状鉴别】药材多皱缩卷曲，有的破碎。完整的叶片展平后呈长椭圆形至长圆状倒披针形；上表面暗灰绿色，有的可见色较深稍突起的小点；先端钝，全缘或微波状，基部狭窄下延至叶柄呈翼状；叶柄淡棕黄色。质脆。气微，味微酸、苦、涩。罗布麻叶（A错）：【性状鉴别】药材多皱缩卷曲，有的破碎，完整叶片展平后呈椭圆状披针形或卵圆状披针形，淡绿色或灰绿色，先端钝，有小芒尖，基部钝圆或楔形，边缘具细齿，常反卷，两面无毛，叶脉于下表面突起；叶柄细。质脆，气微，味淡。艾叶（B错）：【性状鉴别】药材多皱缩、破碎，有短柄。完整叶片展平后呈卵状椭圆形，羽状深裂，裂片椭圆状披针形，边缘有不规则的粗锯齿；上表面灰绿色或深黄绿色，有稀疏的柔毛和腺点；下表面密生灰白色绒毛。质柔软。气清香，味苦。蓼大青叶（C错）：【性状鉴别】药材叶多皱缩、破碎。完整者展平后呈椭圆形，蓝绿或蓝黑色，先端钝，基部渐狭，全缘。叶脉浅黄棕色，于下表面略突起。叶柄扁平，偶带膜质托叶鞘。质脆。气微，味微涩而稍苦。枇杷叶（D错）：【性状鉴别】药材呈长椭圆形或倒卵形。先端尖，基部楔形，边缘上部有疏锯齿，近基部全缘。上表面灰绿色、黄棕色或红棕色，较光滑；下表面密被黄色绒毛，主脉于下表面显著突起，侧脉羽状；叶柄极短，被棕黄色绒毛。革质而脆、易折断。气微、味微苦。